与磷钼酸试剂反应呈棕褐色的是
A. 二氢黄酮
B. 黄酮醇
C. 黄烷
D. 5-羟基黄烷
E. 4-羟基黄烷

正确答案：A。二氢黄酮

解析：本题考查的是黄酮类化合物的鉴别反应。与磷钼酸试剂反应呈棕褐色的是二氢黄酮（A对）。近来报道二氢黄酮可与磷钼酸试剂反应而呈棕褐色，也可作为二氢黄酮类化合物的特征鉴别反应。